某女，35岁。因肝气不舒导致胸胁痞闷、食滞不消、呕吐酸水。治当疏肝理气、消胀止痛，宜选用的成药是
A. 气滞胃痛颗粒
B. 柴胡舒肝丸
C. 木香顺气丸
D. 逍遥丸
E. 加味逍遥丸

正确答案：B。柴胡舒肝丸

解析：本题考查柴胡舒肝丸的功能。治当疏肝理气、消胀止痛，宜选用的成药是柴胡舒肝丸（B对）。柴胡舒肝丸【功能】舒肝理气，消胀止痛。【主治】肝气不舒，症见胸胁痞闷、食滞不消、呕吐酸水。气滞胃痛颗粒（A错）【功能】疏肝理气，和胃止痛。【主治】肝郁气滞，胸痞胀满，胃脘疼痛。木香顺气丸（C错）【功能】行气化湿，健脾和胃。【主治】湿阻中焦、脾胃不和所致的湿滞脾胃证，症见胸膈痞闷、脘腹胀痛、呕吐恶心、嗳气纳呆。逍遥丸（D错）【功能】疏肝健脾，养血调经。【主治】肝郁脾虚所致的郁闷不舒、胸胁胀痛、头晕目眩、食欲减退、月经不调。加味逍遥丸（E错）【功能】疏肝清热，健脾养血。【主治】肝郁血虚，肝脾不和，两胁胀痛，头晕目眩，倦怠食少，月经不调，脐腹胀痛。